男，40岁。行走时右小腿和足部出现间歇性疼痛1年余，近3个月夜间呈持续性疼痛，足趾呈紫黑色干冷。有吸烟史30余年，每日2包。该患者不应选择的治疗措施是
A. 热疗
B. 严格戒烟
C. 给予止痛剂及镇静剂
D. 手术治疗
E. 高压氧舱治疗

正确答案：A。热疗

解析：青年男性（血栓闭塞性脉管炎好发年龄）患者，吸烟史30余年（血栓闭塞性脉管炎发病相关因素）。行走时右小腿和足部出现间歇性疼痛1年余（间歇性跛行），近3个月夜间呈持续性疼痛（静息痛），足趾呈紫黑色、干冷（提示远端缺血坏死）。该患者诊断考虑血栓闭塞性脉管炎。其治疗措施包括：①一般治疗：严格戒烟（B对），防止受冷、受潮和外伤。疼痛严重者，可用止痛剂及镇静剂（C对）；②非手术治疗：抗血小板聚集与扩张血管药物、高压氧舱治疗（E对）；③手术治疗（D对）。热疗（A错，为本题正确答案）可增加局部组织的需氧量，加重症状。